对α₁受体有选择性阻滞作用的药物是
A. 可乐定
B. 哌唑嗪
C. 普萘洛尔
D. 琥珀胆碱
E. 去甲肾上腺素

正确答案：B。哌唑嗪